女，30岁，面色苍白、乏力1年，皮肤出血点2周。查体：神志清，巩膜轻度黄染，肝肋下未触及，脾肋下2cm。血常规Hb60g/L，RBC1.8×10¹²/L，WBC4.6×10⁹/L，Plt12×10⁹/L，Ret0.12。Coombs实验（＋）。尿Rous实验（—）。骨髓细胞学检查：红系、巨核系明显增生，全片见巨核细胞96个，未见产板型巨核细胞。最可能的诊断是
A. 阵发性睡眠性血红蛋白尿症
B. Evans综合征
C. 巨幼细胞贫血
D. 血栓性血小板减少性紫癜
E. 弥散性血管内凝血

正确答案：B。Evans综合征

解析：青年女性患者（AIHA患者高发人群），1年来面色苍白、乏力（病程缓慢，贫血典型表现），皮肤出血点2周，查体有黄染、脾大，血常规Hb60g/L（正常成年女性血红蛋白为110g/L～150g/L，贫血），RBC1.8×10¹²/L（正常成年女性红细胞为3.5～5.0×10¹²/L，红细胞减少），WBC4.6×10⁹/L（正常成人白细胞4～10×10⁹/L，正常），Plt12×10⁹/L（正常成人血小板100～300×10⁹/L，减少，提示Evens综合征），Ret0.12（网织红细胞比例0.005～0.015，增高）。Coombs实验（＋）（AIHA诊断性试验）。尿Rous实验（—）（尿含铁血黄素试验阴性）。骨髓细胞学检查：红系、巨核系明显增生（骨髓增生），全片见巨核细胞96个（骨髓增生活跃），未见产板型巨核细胞，根据患者的临床表现、体征和实验室检查结果，该患者为自身免疫性溶血性贫血（AIHA），AIHI为慢性血管外溶血，以贫血、黄疸和脾大为特征，本例患者同时继发免疫性血小板减少，此时为Evens综合征（B对），本病病程慢性迁延，容易复发，通常使用糖皮质激素用于控制急性发作，有些持续性血细胞减少的患者需要延长激素治疗疗程或更积极的治疗方式。阵发性睡眠性血红蛋白尿症（A错）以血管内溶血性贫血为主，可伴有血栓形成和骨髓衰竭。典型病人有特征性间歇发作的睡眠后血红蛋血尿，多见于20～40岁，国内男性多于女性，尿Rous实验为阳性。巨幼细胞贫血（C错）与维生素B₁₂和叶酸缺乏有关，本病的特点是呈大红细胞性贫血，骨髓内出现巨幼红细胞、粒细胞及巨核细胞系列，网织红细胞可正常或轻度增高，骨髓象红系呈“核幼浆老”，维生素B₁₂和叶酸水平测听有助于诊断，试验性治疗给予叶酸或维生素B₁₂，如4～6天后网织红细胞上升，有助于确立诊断。血栓性血小板减少性紫癜（D错）临床上以典型的三联征为多见即血小板减少，微血管病性溶血，神经系统损伤；若同时伴有肾损害和发热，则为TTP经典的“五联征”，Coombs试验阴性的微血管病性溶血性贫血（血涂片镜检发现破碎红细胞）和血小板减少是诊断TTP的基本条件。弥散性血管内凝血（E错）（DIC）是由感染、损伤、肿瘤等疾病导致的以严重出血、栓塞、休克、微血管病性溶血为主要表现的临床综合在，诊断应结合原发病，出血、栓塞、休克等特征性临床表现和实验室检查综合判断。